男，44岁。右上腹胀痛3天。伴寒战、高热（39.2℃），食欲不振，乏力。右上腹皮肤有凹陷性水肿。肝肋下5cm，有压痛。血WBC19×10⁹/L，N0.92。B超示右肝内多个2～3cm大小的液性暗区。X线片示右膈肌升高，肝阴影增大。抗感染治疗主要针对的细菌是
A. 产气荚膜梭菌
B. 无芽孢厌氧菌
C. 溶血性链球菌
D. 肉毒梭菌
E. 志贺菌

正确答案：B。无芽孢厌氧菌

解析：中年男性患者，症状：右上腹胀痛，伴寒战、高热，食欲不振，乏力。体征：右上腹皮肤有凹陷性水肿。肝肋下5cm，有压痛。实验室检查：血WBC19×10⁹/L，N0.92。B超示右肝内多个2～3cm大小的液性暗区。X线片示右膈肌升高，肝阴影增大。提示为肝脓肿。细菌性肝脓肿的细菌侵入途径除败血症外，可由腹腔内感染直接蔓延所引起，亦可因脐部感染经脐血管，门静脉而入肝脏。引起细菌性肝脓肿的主要菌类为大肠杆菌、金黄色葡萄球菌、无芽孢厌氧链球菌（B对）、类杆菌属等。